患者，女，15岁。浮肿3月余，下肢为甚，按之凹陷不易恢复，心悸，气促，腰部冷痛，尿少，四肢冷，舌质淡胖，苔白，脉沉。其证候是
A. 湿毒浸淫
B. 湿热壅盛
C. 脾阳虚衰
D. 水湿浸渍
E. 肾阳衰微

正确答案：E。肾阳衰微

解析：腰膝以下，肾气主之，肾阳衰微，阳不化气，水湿下聚，故浮肿，下肢为甚，按之凹陷不易恢复；水气上凌心肺，故心悸，气促；腰为肾府，故腰部冷痛；肾阳衰微，故出现尿少，四肢冷；舌质淡胖，苔白，脉沉，故诊断为肾阳虚衰证（E对）。湿毒浸淫证（A错）的特点为眼睑头面浮肿，延及全身，皮肤光亮，尿少色赤，身发疮痍，甚者溃烂，恶风发热。湿热壅盛证（B错）的特点为遍体浮肿，皮肤绷紧光亮，胸脘痞闷，烦热口渴，小便短赤，或大便干结。水湿浸渍证（D错）的特点为全身水肿，按之没指，小便短少，身体困重，胸闷，纳呆，泛恶，腹胀。